普鲁卡因药液中加入肾上腺素的临床目的包括
A. 延缓吸收
B. 降低毒性反应
C. 延长局麻时间
D. 减少术区出血
E. 以上都正确

正确答案：E。以上都正确

解析：临床应用局麻时常在麻药溶液中加入血管收缩剂，这是由于口腔颌面部血运丰富，对局部麻醉药吸收快。为延缓吸收，加强镇痛效果，延长局麻时间，降低毒性反应，以及减少术区出血，使术野清晰，在局麻药溶液中加入血管收缩剂是完全必要的。掌握“颌面部常用局部麻醉药物”知识点。